男，28岁。间断性腹痛、腹泻、低热1年，结肠镜见回肠末端呈跳跃征，见纵行溃疡，溃疡周围呈鹅卵石样。最可能的诊断是
A. 溃疡性结肠炎
B. 溃疡性肠结核
C. 肠伤寒
D. 肠阿米巴病
E. 克罗恩病

正确答案：E。克罗恩病

解析：青年男性患者，长期间断性腹痛、腹泻、低热，结肠镜见回肠末端呈跳跃征，见纵行溃疡且溃疡周围呈鹅卵石样（克罗恩病的典型肠镜表现），综合患者的病史、临床症状和肠镜检查，该患者最可能的诊断是克罗恩病（E对）。溃疡性结肠炎（P374）（A错）病变多位于直肠、乙状结肠，呈连续性弥漫性分布，其典型临床表现为黏液脓血便，结肠镜检为多发性浅溃疡，而非纵行溃疡。溃疡型肠结核（P368）（B错）好发于回盲部，溃疡沿淋巴管走行方向分布，因此溃疡呈横形而非纵行。肠伤寒（C错）虽然好发于回肠末端，但肠伤寒是由伤寒杆菌引起的急性传染病，其典型临床表现可概括为：伤寒肚子伤寒脸，梯形体温脉搏缓，三五千个白血球，周末脾大玫瑰现。典型伤寒自然病程约为4周，且溃疡呈圆形或椭圆形。肠阿米巴病变（D错）主要侵犯右半结肠，溃疡较深，边缘潜行，溃疡间黏膜多正常，可出现腹泻，其特征性表现为伴有腥臭味的暗红色果酱样大便。